关于分析流行病学描述正确的是
A. 为病因研究提供线索
B. 提出病因假设
C. 证实或确证假设
D. 检验假设
E. 描述疾病和健康状态的分布

正确答案：D。检验假设

解析：本题考查分析流行病学的用途。分析流行病学主要是为了检验假设（D对ABCE错）。